在病理情况下，粪隐血可见于
A. 脂肪或酪蛋白食物消化不良
B. 消化道溃疡
C. 痛风
D. 胰腺炎
E. 骨折

正确答案：B。消化道溃疡

解析：本题考查粪常规检查。在病理情况下，粪隐血可见于消化道溃疡（B对）。粪隐血可见于如下病理情况：1.消化道溃疡：胃、十二指肠溃疡患者的隐血阳性率可达40%～70%，可呈间歇性阳性，虽出血量大但呈非持续性。2.消化道肿瘤：胃癌、结肠癌患者的隐血阳性率可达87%～95%，出血量小但呈持续性。3.其他疾病：肠结核、克罗恩病、溃疡性结肠炎。